患儿，1岁。发热，鼻塞流涕，咽部充血，兼见咳嗽，喉间痰多，甚则气急痰鸣，舌苔厚腻。其诊断是
A. 风寒感冒
B. 风热感冒
C. 感冒夹痰
D. 感冒夹惊
E. 感冒夹滞

正确答案：C。感冒夹痰

解析：患儿以发热、鼻塞、流涕为主症，故诊断为感冒；咽部充血初步提示风热，但证据不充分；咳嗽，喉间痰多，甚则气急痰鸣，舌苔厚腻，提示感冒夹痰，是由于肺脏受邪，失于清肃，气机不利，津液凝聚为痰，以致痰阻气道所致，故本病例的诊断为感冒夹痰（C对）。风寒感冒（A错）其临床表现为发热，恶寒，无汗，头痛，鼻流清涕，打喷嚏，咳嗽，口不渴，咽部不红肿，舌淡红，苔薄白，脉浮紧或指纹浮红。风热感冒（B错）其临床表现为发热，恶风，有汗或少汗，头痛，鼻塞，鼻流浊涕，喷嚏，咳嗽，痰稠色白或黄，咽红肿痛，口干渴，舌质红，苔薄黄，脉浮数或指纹浮紫。感冒夹惊（D错）其临床表现为感冒兼见惊惕哭闹，睡卧不宁，甚至骤然抽搐，舌质红，脉浮弦。感冒夹滞（E错）其临床表现为感冒兼见脘腹胀满，不思饮食，呕吐酸腐，口气秽浊，大便酸臭，或腹痛泄泻，或大便秘结，小便短黄，舌苔厚腻，脉滑。